男孩，9岁。眼睑水肿伴少尿3天，茶色尿1天，病前3周出现皮肤脓肿，疱疮。查体：P110次/分，BP130/90mmHg，肝右肋下1cm，压痛（+），双下肢明显非凹陷性水肿。目前最主要的治疗措施是
A. 卡托普利
B. 青霉素
C. 限盐饮食
D. 呋塞米
E. 休息

正确答案：D。呋塞米

解析：患儿3周前曾有皮肤感染，先出现水肿、血尿（茶色尿）、高血压（小儿血压正常值的计算方法：收缩压=年龄x2+80毫米汞柱，舒张压是收缩压得2/3，9岁小孩正常血压约98/65mmHg），提示急性肾小球肾炎。由于患儿肝肿大且有压痛，提示有严重的循环充血，需尽快予以利尿剂对症治疗，首选强效利尿剂呋塞米（D对）。利尿的同时应注意血压变化及电解质紊乱。卡托普利（A错）是血管紧张素转换酶抑制剂，凡经休息、控制水、盐摄入，利尿而血压仍高者均应给与降压药。青霉素（B错）有感染灶时用10～14天，目前患儿未见感染灶。目前患儿有严重的循环充血，应当立刻予以利尿药对症治疗，同时可限盐（C错）甚至无盐饮食、卧床休息（E错）。